女性，11岁。诉左下颌后牙反复肿痛3个月余。口腔检查见；左下Ⅴ残冠，松动Ⅱ°，颊侧牙龈沟内溢脓，合理的治疗方案是
A. 干髓术
B. 根尖诱导形成术
C. 根管治疗
D. 拔除
E. 服用抗生素消炎

正确答案：D。拔除

解析：女性，11岁。诉左下颌后牙反复肿痛3个月余。口腔检查见；左下Ⅴ残冠，松动Ⅱ°，颊侧牙龈沟内溢脓，合理的治疗方案是拔除（D对）。根尖诱导形成术（B错）适用对象为年轻恒牙，本题中左下Ⅴ为乳牙，故不适用。在正常情况下，下颌第二前磨牙在11～12岁左右萌出，患者此时11岁，左下Ⅴ即将被左下第二前磨牙所代替，且牙冠破坏严重，伴根尖炎症，松动度较大，无保留价值，无需做根管治疗（C错）或干髓术（A错），只能拔除。服用抗生素消炎（E错）一般仅作为辅助治疗来消除牙髓或牙周组织的炎症。